下列局麻药中毒性最大的药是
A. 利多卡因
B. 普鲁卡因
C. 依替卡因
D. 丁卡因
E. 布比卡因

正确答案：D。丁卡因